中医学认为，甲状腺功能亢进症的基本病理是
A. 气滞、血瘀、火盛
B. 痰凝、血瘀、正虚
C. 痰凝、火盛、血瘀
D. 气滞、痰凝、瘀阻
E. 气滞、火盛、痰凝

正确答案：E。气滞、火盛、痰凝

解析：甲亢的临床表现为甲状腺弥漫性肿大，患者性情急躁、容易激动、失眠、两手颤动、怕热、多汗、食欲亢进但反而消瘦、心悸、脉快有力、脉压增大。其中脉率增快及脉压增大尤为重要，常可作为判断病情和疗效的重要标志。据其临床表现中医学认为是气滞、火盛、痰凝等作祟所致（E对）。